在下列各项中，不属于病人道德义务的是
A. 支持医学科研
B. 支付医疗费用
C. 配合医学生实习
D. 协助护士护理其他病人
E. 尊重医务人员的劳动

正确答案：D。协助护士护理其他病人

解析：不属于病人道德义务的是协助护士护理其他病人（D错，为本题正确答案）。病人的道德义务是保持和恢复健康的义务，积极配合诊疗的义务，尊重医务人员、文明就医的义务，遵守医院规章制度的义务，支持医学科学研究和医学教育的义务等。